用药后30分钟内不宜进食或者饮水的剂型是
A. 咀嚼片
B. 舌下片
C. 泡腾片
D. 阴道栓
E. 控释片

正确答案：B。舌下片

解析：本题考查各种剂型的正确使用。舌下片（B对）应用时宜注意：①给药时宜迅速，含服时把药片放于舌下；②含服时间一般控制在5min左右，以保证药物充分吸收；③不要咀嚼或吞咽药物，不要吸烟、进食、嚼口香糖，保持安静，不宜多说话；④含后30min内不宜吃东西或饮水。咀嚼片（A错）在口腔内的咀嚼时间宜充分，咀嚼后可用少量温开水送服。泡腾片（C错）宜用100～150ml凉开水或温水浸泡，可迅速崩解和释放药物，应待完全溶解或气泡消失后再饮用，严禁直接服用或口含。阴道栓（D错）在给药后1～2h内尽量不排尿，以免影响药效。服用缓、控释制剂的药片（E错）或胶囊时，除另有规定外，一般应整片或整丸吞服，严禁嚼碎和击碎分次服用。